佝偻病活动期合并肺炎时对佝偻病的主要处理是
A. 口服鱼肝油
B. 口服钙剂
C. 晒太阳
D. 肌注维生素D₃
E. 暂不治疗

正确答案：D。肌注维生素D₃

解析：本题考查佝偻病活动期合并肺炎的处理原则。佝偻病是涉及全身各系统产生病变的一种小儿常见病，可引起小儿并发症肺炎。当佝偻病活动期有并发症肺炎或无法口服者可肌内注射维生素D₃（D对ABCE错），3个月后改预防量。